治疗神经衰弱阴虚火旺证，应首选
A. 右归丸
B. 肾气丸
C. 酸枣仁汤
D. 大补阴丸
E. 天王补心丹

正确答案：D。大补阴丸

解析：大补阴丸（D对）加减可以滋阴降火，交通心肾，用于治疗神经衰弱阴虚火旺证。右归丸（A错）可温补肾阳，填精益髓，治疗肾阳不足，命门火衰证。肾气丸（B错）可补肾助阳，治疗肾阳不足证。酸枣仁汤（C错）可清热除烦，养血安神，治疗肝血不足，虚热扰神证。天王补心丹（E错）可补心安神，滋阴清热，治疗阴亏内热，心神不宁证。